河豚毒素的主要毒作用是
A. 引起血压下降
B. 引起颅神经损伤
C. 引起体温下降
D. 抑制咳嗽反射
E. 作用于周围神经及脑干中枢致神经呈麻痹状态

正确答案：E。作用于周围神经及脑干中枢致神经呈麻痹状态

解析：河豚中毒：河豚主要含河豚毒素，是一种神经毒素，进入人体后作用于周围神经及脑干中枢致神经呈麻痹状态。早期症状是口唇、舌、指尖发麻，眼睑下垂，不久即出现消化道症状，进而出现口唇、舌尖及肢端麻木、四肢无力或肌肉麻痹、共济失调等神经系统症状。重症者出现瘫痪、言语不清、发绀、呼吸困难、神志不清、休克，最后因呼吸、循环衰竭而死亡。掌握“食品安全”知识点。